生用行气力强，煨用力缓并止泻的药是
A. 橘皮
B. 甘松
C. 木香
D. 白扁豆
E. 川楝子

正确答案：C。木香